属于患者门诊教育形式的是
A. 入院教育
B. 随诊教育
C. 随访教育
D. 出院教育
E. 病房教育

正确答案：B。随诊教育